药品说明书是
A. 医生和病人在治疗用药时的科学依据
B. 是药品生产单位承担法律责任的重要依据
C. 是论文的表现形式之一
D. 是药品报请审批的必备材料之一
E. 是药品的广告

正确答案：A、B、D。医生和病人在治疗用药时的科学依据；是药品生产单位承担法律责任的重要依据；是药品报请审批的必备材料之一

解析：本题考查药品说明书。药品说明书是医生和病人在治疗用药时的科学依据（A对），是药品生产单位承担法律责任的重要依据（B对），是药品报请审批的必备材料之一（D对）。论文的表现形式（C错）并不会通过药品说明书来体现。药品的广告（E错）传播途径也不会通过药品说明书来体现。